慢性应激时GC的持续增加对机体产生的不利影响有
A. 抑制免疫炎症反应
B. 生长发育迟缓
C. 对性腺功能的抑制
D. 对甲状腺功能的抑制
E. 以上都是

正确答案：E。以上都是

解析：抑制免疫炎症反应（A对）、生长发育迟缓（B对）、对性腺和甲状腺功能的抑制（CD，故E为本题正确答案对）均为慢性应激时GC的持续增加对机体产生的不利影响。